平静吸气时，参与呼吸动作的最主要的肌肉是
A. 膈肌和肋间内肌
B. 膈肌和斜角肌
C. 膈肌和肋间外肌
D. 斜角肌和胸锁乳突肌
E. 膈肌和胸锁乳突肌

正确答案：C。膈肌和肋间外肌

解析：平静吸气时，参与呼吸动作的最主要的肌肉是膈肌和肋间外肌（C对）；平静呼气时，参与呼吸动作的最主要的肌肉是肋间内肌（A错）和腹肌。胸锁乳突肌和斜角肌（BDE错）是一些辅助吸气肌，只有在用力呼吸时才参与呼吸动作。